艾滋病的孕妇引起胎儿感染属于
A. 医源性传播
B. 垂直传播
C. 水平传播
D. 接触传播
E. 间接传播

正确答案：B。垂直传播

解析：本题考查艾滋病的传播途径。艾滋病的孕妇引起胎儿感染属于垂直传播（B对）。医源性传播（A错）指在医疗、预防工作中，由于未能严格执行规章制度和操作规程，而人为地造成某些传染病的传播。水平传播（C错）包括呼吸道传播、消化道传播、接触传播、虫媒传播、血液、体液传播等。接触传播（D错）指易感者与被病原体污染的水或土壤接触时获得感染，如钩端螺旋体病、血吸虫病和钩虫病等，或日常生活的密切接触也有可能获得感染。间接传播（E错）是指传染源不与被感染者直接接触，由媒介（像苍蝇等）参与，或是公用物品等传播疾病。